高血压患者按照常规剂量服用哌唑嗪片，开始治疗时产生眩晕、心悸、体位性低血压。这种对药物尚未适应而引起的不可耐受的反应称为
A. 继发性反应
B. 首剂效应
C. 后遗效应
D. 毒性反应
E. 副作用

正确答案：B。首剂效应

解析：本题考查药品不良反应的分类。高血压患者按照常规剂量服用哌唑嗪片，开始治疗时产生眩晕、心悸、体位性低血压。这种对药物尚未适应而引起的不可耐受的反应称为首剂效应（B对）。继发性反应（A错）是由于药物的治疗作用所引起的不良后果，又称为治疗矛盾。后遗效应（C错）是指在停药后，血药浓度已降至最小有效浓度以下时残存的药理效应。毒性反应（D错）是指在剂量过大或药物在体内蓄积过多时发生的危害性反应。副作用（E错）是指在药物按正常用法用量使用时，出现的与治疗目的无关的不适反应。